多聚甲醛用于牙髓失活时，封药时间需
A. 24～48小时
B. 二到四天
C. 五到七天
D. 两周
E. 二十天

正确答案：D。两周

解析：本题考查多聚甲醛失活剂性能。多聚甲醛用于牙髓失活时，封药时间需两周（D对）。三氧化二砷为24～48小时（A错）。慢性失活剂金属砷恒牙为7～10天，乳牙为2～4天（BC错）。